水溶性小的刺激性气体对人体的重要危害为
A. 喉头痉挛
B. 支气管痉挛
C. 化学性肺水肿
D. 眼结膜充血
E. 皮肤溃疡

正确答案：C。化学性肺水肿